天冬的功效有
A. 清肺降火
B. 滋阴潜阳
C. 软坚散结
D. 润肠通便
E. 滋阴润燥

正确答案：A、D、E。清肺降火；润肠通便；滋阴润燥

解析：本题考查的是天冬的功效。天冬的功效有清肺降火（A对）、润肠通便（D对）与滋阴润燥（E对）。天冬：【功效】滋阴降火，清肺润燥，润肠通便。鳖甲：【功效】滋阴潜阳（B错），退热除蒸，软坚散结（C错）。